可以引起视物模糊、红绿色盲视野受限的药物是
A. 对氨基水杨酸钠
B. 乙胺丁醇
C. 异烟肼
D. 链霉素
E. 利福平

正确答案：B。乙胺丁醇

解析：本题考查药物的不良反应。乙胺丁醇（B对）的不良反应有：①球后视神经炎（视力模糊、红绿色盲、视野受限），通常停药后可恢复；②抑制尿酸排泄，可发生高尿酸血症；③肝功能损害；④不宜用于13岁以下小儿；⑤与乙硫异烟胺合用可增加不良反应等。对氨基水杨酸钠（A错）主要的不良反应是胃肠道不适、肝炎、狼疮样综合征等。异烟肼（C错）主要的不良反应是周围神经炎、肝功能损害。链霉素（D错）主要的不良反应是听力障碍，眩晕，肾功能损害。利福平（E错）是CYP3A4的强效诱导剂，可加速多种药物的代谢如口服避孕药、环孢素、维拉帕米、口服降血糖药、奎尼丁等，这些药物与利福平合用需增加剂量。